某高校心理咨询工作人员接待了一位大学生，该生对心理咨询员说，他多次难以自控地想自杀及杀其女友。那么，此情况下心理咨询员的最佳做法是
A. 劝其尽快接受治疗
B. 严格保守该生的秘密
C. 告知该生女友家属对其进行保护，同时建议该生家属带其进行必要的心理诊治
D. 通知该生的家长对其妥善监管
E. 联系精神病医院并直接送该生入院

正确答案：C。告知该生女友家属对其进行保护，同时建议该生家属带其进行必要的心理诊治

解析：危机干预是对处于困境或遭受挫折的人予以关怀和短程帮助的一种方式。危机干预是在短程心理治疗基础上发展起来的治疗方法，主要以解决问题为目的，强调时间紧迫性和效果，不涉及对当事人的人格矫正。多用于个人和群体性灾难的受害者，重大事件目击者，有伤害自身和他人企图等人群的心理干预。题目中大学生有自杀和伤害女友的企图，心理咨询员应采取危机干预。首先应对危机干预进行评估，而后明确危机问题。确保当事人安全是危机干预的最重要原则，指尽可能将当事人在身体上或心理上对自己或他人造成危险的 可能性降到最低。本题中心理咨询师应该告知该女生家属对其进行保护，并建议该生家属带其进行心理治疗（C对），而不是单纯劝其治疗（A错）和通知家长监管（D错），帮助该生保密（B错）无益治疗，更不可对患者强制入院（E错）。